阿片受体括抗剂是
A. 美沙酮
B. 地西泮
C. 可乐定
D. 洛非西啶
E. 纳洛酮

正确答案：E。纳洛酮